有关内耳的描述,何者错误
A. 在颞骨岩部骨质内，位于鼓室与内耳道底之间
B. 包括骨迷路和膜迷路
C. 膜迷路内有听觉、位置觉感受器
D. 膜迷路与骨迷路间有外淋巴,膜迷路内有内淋巴，内、外淋巴互相交通
E. 椭圆囊斑和球囊魔可感受直线变速运动的刺激

正确答案：D。膜迷路与骨迷路间有外淋巴,膜迷路内有内淋巴，内、外淋巴互相交通

解析：内耳位于颞骨岩部的骨质内，介于鼓室和内耳道底之间（A对）。其形状不规则，构造复杂，又称迷路，由骨迷路和膜迷路两部分组成（B对）。骨迷路与膜迷路之间充满外淋巴，膜迷路内充满内淋巴，内、外淋巴互不相通（D错，为本题正确答案）。椭圆囊斑和球囊斑均属位觉感受器，感受头部静止的位置及直线变速运动引起的刺激（E对）。在螺旋膜上有螺旋器，是听觉感受器，故膜迷路上有听觉及位觉感受器（C对）。